患儿，男，2天，足月顺产，巩膜皮肤黄染1天，面色苍白，精神差，体温正常，心肺尢异常，腹较胀，Hb110g/L，血中结合胆红素升高，见有核红细胞，该患者最可能的诊断
A. 生理性黄疸
B. 败血症
C. 溶血性黄疸
D. 肝炎
E. 先天胆道闭塞

正确答案：C。溶血性黄疸

解析：本题考查溶血性黄疸的证候特点。溶血性黄疸临床特点：Rh溶血病大多于出生24小时内出现黄疸，血清胆红素以未结合胆红素为主，有少数患儿可因胆汁淤积而在恢复期出现结合胆红素明显升高。轻者可无明显贫血，重者易发生贫血性心力衰竭，肝脾大（C对）。生理性黄疸特点：足月儿生后2～3天出现黄疸，4～5天达高峰，5～7天消退（A错）。败血症临床特点：早期症状不典型，表现为进奶量减少或不吃，发热或体温不升，哭声低，面色苍白，精神萎靡（B错）。新生儿肝炎起病常缓慢，多于生后1～3周出现黄疸（D错）。先天性胆道闭塞特点：黄疸常在生后2～3周出现并呈进行性加重（E错）。